佝偻病恢复期X线表现
A. 干骺端增厚，钙化带模糊或消失，呈毛刷样杯口状改变
B. 钙化带重新出现，致密增厚
C. 骨骼无明显改变
D. 长骨短曲和弯曲，干骺端变宽，呈喇叭口状，轮廓光整
E. 长骨钙化预备带密度增加，骨皮质增厚及骨硬化

正确答案：B。钙化带重新出现，致密增厚

解析：恢复期X线表现于2～3周后即有改善，临时钙化带重新出现，逐渐致密并增宽，骨质密度增厚，逐步恢复正常。掌握“维生素D缺乏性佝偻病”知识点。